若肝胃蕴热，其口味应是
A. 口中味苦
B. 口中酸馊
C. 口中味咸
D. 口中泛酸
E. 口甜粘腻

正确答案：D。口中泛酸

解析：肝胃蕴热时，肝火横逆犯胃，木郁作酸，故见泛吐酸水（D对）。口中味苦，见于实热证，尤以心、肝、胆火旺者多见（A错）。口中酸馊，多因暴饮暴食，损伤胃肠，食积不化，胃中浊气上泛所致（B错）。口中味咸，见于肾虚或寒证（C错）。口甜黏腻，脘闷不舒，舌苔黄腻者，为脾胃湿热（E错）。